女性，12岁，鼻出血，躯干及四肢淤点瘀斑，发病前2周有感冒史，脾不肿大，血小板20×10⁹/L，出血时间2分，凝血时间正常，束臂试验阳性，PT正常，骨髓象增生，巨核细胞增多，幼稚型巨核细胞0.40，产血小板型巨核细胞缺少，诊断为
A. 再生障碍性贫血
B. ITP
C. 急性白血病
D. 过敏性紫癜
E. 慢性ITP

正确答案：B。ITP

解析：女性，12岁，鼻出血，躯干及四肢淤点瘀斑（ITP常见症状），发病前2周有感冒史（因感染加重），脾不肿大，血小板20×10⁹/L（＜正常100-300×10⁹/L），出血时间2分钟（正常4-8分钟，超过9分钟为异常），凝血时间正常，束臂试验阳性（提示血管壁异常），PT正常，骨髓象增生，巨核细胞增多，幼稚型巨核细胞0.40，产血小板型巨核细胞缺少（幼稚巨核细胞增加，产板型巨核细胞减少为ITP典型表现），综上考虑诊断为ITP（B对）。再生障碍性贫血（A错）在骨髓象检查中会看到三系造血细胞减少，非造血细胞增多。急性白血病（C错）在骨髓象检查中可见原始细胞明显增多。过敏性紫癜（D错）的血小板计数正常或升高。慢性ITP（E错）指血小板减少持续超过12个月的ITP病人。